阻止HO·生成最有效的方法是
A. 抗氧化剂
B. 超氧化物歧化酶
C. 及时清除O²⁻
D. DT-黄递酶
E. NADPH依赖性黄素酶

正确答案：C。及时清除O²⁻